关于中药提取液分离的相关叙述，错误的是
A. 中药提取液常用的固液分离方法有沉降分离法、离心分离法和滤过分离法
B. 沉降分离法系指固体微粒因其本身重力在液体介质中自然下沉使之与液体分离的方法
C. 分离因数（仪）是物料所受离心力与重力之比值，其值越大，表明该离心机分离能力越强
D. 滤过分离时，滤速与压力差成反比
E. 在黏性料液中加助滤剂有利于滤过分离

正确答案：D。滤过分离时，滤速与压力差成反比

解析：本题考查中药分离的主要内容。关于中药提取液分离的相关叙述，错误的是滤过分离时，滤速与压力差成反比（D错，为本题正确答案）。滤过分离法：滤过机理主要有过筛作用和深层滤过作用。影响滤过速度的因素有：①滤渣层两侧的压力差：压力差越大，则滤速越快，故常用加压或减压滤过。②滤器面积：在滤过初期，滤过速度与滤器面积成正比。③过滤介质或滤饼毛细管半径：滤饼半径越大，滤过速度越快，但在加压或减压时应注意避免滤渣层或滤材因受压而过于致密。常在料液中加入助滤剂以减小滤饼阻力。④过滤介质或滤饼毛细管长度：滤饼毛细管长度愈长，则滤速愈慢。常采用预滤、减小滤渣层厚度、动态滤过等加以克服，同时操作时应先滤清液后滤稠液。⑤料液黏度：黏稠性愈大，滤速愈慢。因此，常采用趁热滤过或保温滤过。另外，添加助滤剂亦可降低黏度（E对）。将固体-液体非均相体系用适当方法分开的过程称为固-液分离。中药提取液的精制、药物重结晶等均要进行分离操作；注射剂的除菌也用到分离技术。分离方法一般有三类：沉降分离法、离心分离法和滤过分离法（A对）。沉降分离法：系指固体物与液体介质密度相差悬殊，固体物靠自身重量自然下沉（B对），用虹吸法吸取上层澄清液，使固体与液体分离的一种方法。离心分离法：离心分离法与沉降分离法皆是利用混合液密度差进行分离的方法。不同之处在于离心分离的力为离心力，而沉降分离的力为重力。分离因数（仪）是物料所受离心力与重力之比值，其值越大，表明该离心机分离能力越强（C对）。